为保障工人的健康，预防职业病的发生，按照《职业病防治法》的要求，某化工厂定期进行生产环境监测，为工人进行健康检查，建立健康档案并定期分析。以上所做的工作为
A. 职业流行病学研究
B. 现场劳动卫生学调查
C. 生物监测
D. 健康监护
E. 职业危险风险评估

正确答案：D。健康监护

解析：工人是职业人群，对工厂定期进行生产环境监测是为保障职业人群健康的工作环境，为工人进行健康检查，建立健康档案并定期分析以便适时发现健康隐患，采取相应的预防措施防止有害因素所致疾患的发生和发展，以上所做工作都属于职业健康人群健康监护的内容（D对）（P308）。